患者男性，32岁，因反复出现癫痫大发作半年余，近一月来智力有所下降，经CT检查诊断为脑囊虫病。其可能的临床类型是
A. 软脑膜型
B. 脑室型
C. 混合型
D. 皮质型
E. 脊髓型

正确答案：D。皮质型